感染性休克大剂量应用糖皮质激素治疗的时间最长不宜超过
A. 1天
B. 5天
C. 3天
D. 7天
E. 2天

正确答案：E。2天

解析：感染性休克应用糖皮质激素治疗时，糖皮质激素能抑制多种炎症介质的释放和稳定溶酶体膜，缓解全身炎症反应综合征。但应用限于早期、用量宜大，可达正常用量的10～20倍，维持不宜超过48小时，否则有发生急性胃黏膜损害和免疫抑制等严重并发症的危险，即感染性休克大剂量应用糖皮质激素治疗的时间最长不宜超过2天（E对）。